咽鼓管鼓室口开口于鼓室的哪个壁
A. 上壁
B. 下壁
C. 前壁
D. 后壁
E. 膜半规管

正确答案：C。前壁

解析：咽鼓管鼓室口开口于鼓室的前壁（C对）。